在下述情况中，排除无芽胞厌氧菌的依据是
A. 机体多个部位的脓疡
B. 血性分泌物，恶臭或有气体
C. 分泌物直接涂片可见细菌
D. 在普通肉汤培养基中呈表面生长
E. 在血平板中长出微小菌落

正确答案：D。在普通肉汤培养基中呈表面生长

解析：无芽胞厌氧杆菌在人体正常菌群中占有绝对优势，可作为机会致病菌引起内源性感染，感染部位可遍及全身，多呈慢性过程，形成机体多个部位的脓肿（A对），可分泌血性分泌物，恶臭或有气体（B对），分泌物直接涂片可见细菌（C对）。无芽胞厌氧菌的生长条件为无氧的环境，可在营养丰富的特殊血平板上生长出微小菌落（E对），但普通肉汤培养基为有氧的环境，无芽胞厌氧菌无法生长（D错，为本题正确答案）。